“中焦如沤”是描绘
A. 胃的受纳功能
B. 脾的散精功能
C. 小肠的泌别清浊功能
D. 脾胃等脏腑消化水饮食物的生理过程
E. 心肺输布气血的作用

正确答案：D。脾胃等脏腑消化水饮食物的生理过程

解析：中焦如沤：喻指中焦消化饮食物的作用，如发酵酿造之过程，是对脾胃、肝胆等脏腑的消化饮食物的作用和形式的描绘（D对）。“上焦如雾”指的是心肺输布气血的作用（E错）。